下列属于胰岛素的不良反应的是
A. 过敏性休克
B. 高钾血症
C. 脂肪萎缩与肥厚
D. 抑制生长发育
E. 粒细胞减少

正确答案：A、C。过敏性休克；脂肪萎缩与肥厚

解析：本题考查胰岛素的不良反应。胰岛素的不良反应是过敏性休克（A对）、脂肪萎缩与肥厚（C对）。肾功能不全或使用醛固酮受体拮抗剂螺内酯等可引起高钾血症（B错）。儿童用的糖皮质类激素药物可能会抑制生长发育（D错）。口服降糖药可能引起粒细胞减少（E错）。